N-（4-羟基苯基）乙酰胺
A. 药品通用名
B. 化学名
C. 拉丁名
D. 商品名
E. 俗名

正确答案：B。化学名

解析：本题考查药物的命名。N-（4-羟基苯基）乙酰胺是化学名（B对）。N-（4-羟基苯基）乙酰胺是表述化学药物扑热息痛化学结构的化学名称。药品通用名（A错）通常是指有活性的药物物质，而不是最终的药品。拉丁名（C错）是生药在国际上的通用名称。商品名（D错）通常是针对药物的最终产品，即剂量和剂型已确定的含有一种或多种药物活性成分的药物。俗名（E错）是对药品非正式的名称，如“蒙汗药”就是三唑仑的俗称。